右心衰竭的主要体征是
A. 动脉压下降
B. 颈静脉怒张
C. 心音低钝
D. 急性肺水肿
E. 端坐呼吸

正确答案：B。颈静脉怒张

解析：右心衰竭时，右室射血能力下降，使右心房容量负荷增高，上腔静脉回流受阻，造成颈静脉怒张（B对），为右心衰竭的主要体征。左心衰竭患者由于左室射血能力下降，心输出量降低，有效循环血量减少，发病开始血压有一过性升高，病情如不缓解，可导致动脉压下降（A错）甚至休克。当左心衰竭导致的肺淤血达到一定程度后，患者由于平卧时回心血量增加而使呼吸更为困难，高枕卧位、半卧位甚至端坐时方可好转，称为端坐呼吸（E错）。随着病程的发展，最终可发生急性肺水肿（D错）而威胁生命。心音低钝（C错）多见于胸壁肥厚、心包积液、休克等。